用沉降公式（Stock's方程）求出的粒径称为
A. 定方向径
B. 等价径
C. 体积等价径
D. 筛分径
E. 有效径

正确答案：E。有效径

解析：本题考查粒子大小的表示方法。粒子大小的常用表示方法有：①定方向径：在显微镜下按同一方向测得的粒子径。 ②等价径：粒子的外接圆的直径。 ③体积等价径：与粒子的体积相同球体的直径。 ④有效径（E对）：根据沉降公式计算所得的直径。 ⑤筛分径：即用筛分法测得的直径。